在临床上，化学性肺水肿主要分为哪几期
A. 急性期、慢性期、肺水肿期
B. 刺激期、肺水肿期、恢复期
C. 潜伏期、肺水肿期、痊愈期
D. 刺激期、潜伏期、肺水肿期、痊愈期
E. 刺激期、潜伏期、肺水肿期、恢复期

正确答案：E。刺激期、潜伏期、肺水肿期、恢复期